患者，男，40岁。90%完全脱位牙需进行再植，可避免牙根吸收的时间是在外伤后
A. 30分钟以内
B. 1小时以内
C. 90分钟以内
D. 2小时以内
E. 12小时以内

正确答案：A。30分钟以内

解析：本题考查牙脱位。离体再植的牙，在处理好离体牙及牙槽窝情况下宜尽早植入，以利于牙周组织的愈合，最佳时间0.5小时（A对）。